备洞过程可能对牙髓造成伤害的主要原因
A. 牙髓牙本质是复合体
B. 切割了牙本质小管
C. 切割了成牙本质细胞突
D. 切割时产热
E. 切割时使用了涡轮机

正确答案：D。切割时产热

解析：本题考查备洞过程对牙髓造成伤害的原因。备洞时产热是造成牙髓损伤的主要原因（D对）。备洞过程中对牙髓的物理刺激，如过冷的水冲洗窝洞、连续钻磨产热及钻牙的负压均可激惹牙髓，致牙髓充血。牙体预备可对牙髓牙本质复合体（A错）产生机械、压力和温度刺激，引起牙髓炎症。